具有降胃气止呕功效的药物是
A. 白芥子
B. 紫苏子
C. 葶苈子
D. 杏仁
E. 旋覆花

正确答案：E。旋覆花

解析：旋覆花苦泄辛散，微温而降，主入肺、胃经，兼入脾与大肠经。既下气行水消痰，又降胃气止呕哕，为治肺胃气逆之要药（E对）。白芥子（A错）功效温肺豁痰利气，散结通络止痛。紫苏子（B错）功效降气化痰，止咳平喘，润肠通便。葶苈子（C错）功效泻肺平喘，行水消肿。杏仁（D错）功效降气止咳平喘，润肠通便。